关于基本医疗保险定点零售药店管理的说法，正确的有
A. 定点零售药店对外配处方要分别管理，单独建账，定期向社会保险经办机构报告服务和费用发生情况
B. 定点零售药店应配备和实行“零差率”销售基本药物
C. 定点零售药店应具备及时供应基本医疗保险用药的能力
D. 定点零售药店应具备24小时提供服务的能力

正确答案：A、C、D。定点零售药店对外配处方要分别管理，单独建账，定期向社会保险经办机构报告服务和费用发生情况；定点零售药店应具备及时供应基本医疗保险用药的能力；定点零售药店应具备24小时提供服务的能力

解析：本题考查定点药店的管理。定点零售药店和处方外配的管理要求，基本药物补偿规定：一、定点零售药店处方外配应分别管理、单独建账，定期向统筹地区社会保险经办机构报告处方外配服务及费用发生情况（A对）。二、实施基本药物制度的政府办城市社区卫生服务机构和县，要全部配备使用基本药物并实现零差率销售（B错）。三、定点零售药店的资格与条件：具备及时供应基本医疗保险用药（C对）、24小时提供服务的能力（D对）。